取供试品，加氢氧化钠试液溶解后，加铁氰化钾试液和正丁醇，振摇，放置分层后醇层显强烈的蓝色荧光，加酸使成酸性，荧光消失，再加碱使成碱性，荧光又出现。此反应可鉴别的药物是
A. 维生素A
B. 维生素B₁
C. 维生素C
D. 青霉素钠
E. 硫酸链霉素

正确答案：B。维生素B₁

解析：本题考查常用的药品鉴别方法。取供试品，加氢氧化钠试液溶解后，加铁氰化钾试液和正丁醇，振摇，放置分层后醇层显强烈的蓝色荧光，加酸使成酸性，荧光消失，再加碱使成碱性，荧光又出现。此反应可鉴别的药物是维生素B₁（B对）。
维生素B₁在碱性条件下与铁氰化钾反应生成具有蓝色荧光的硫色素，称为硫色素反应。维生素C（C错）可使二氯靛酚钠试液褪色。